双侧平衡（牙合）的咬合接触是指
A. 前、后牙均无接触
B. 非工作侧多个后牙接触
C. 工作侧多个后牙接触
D. 工作侧和非工作侧均无接触
E. 工作侧和非工作侧均有接触

正确答案：E。工作侧和非工作侧均有接触

解析：本题考查双侧平衡（牙合）。双侧平衡（牙合）的咬合接触是指工作侧和非工作侧均有接触（E对）。双侧平衡（牙合） 是全口义齿修复的（牙合）型要求，天然牙中少有，因为双侧平衡（牙合）会造成牙列的快速磨损。双侧平衡（牙合）是义齿固位和稳定所必需的，但不适于天然牙列。双侧平衡（牙合）可分为正中平衡（牙合）、前伸平衡（牙合）和侧方平衡（牙合）。（1）正中平衡（牙合）：下颌在正中（牙合）位（最广泛接触位或牙尖交错位）时，上下颌人工牙间具有尖窝交错的最大面积的广泛均匀接触。（2）前伸平衡（牙合）：当下颌前伸至上下前牙相对，在滑回正中（牙合）位过程中前后牙都有接触，按后牙的接触情况，可分为三点接触的、多点接触的和完全接触的前伸平衡。（3）侧方平衡（牙合）：下颌向一侧作咬合接触滑动运动时，两侧后牙均有接触。